子宫颈癌转移最常见为
A. 直接蔓延
B. 医源转移
C. 血行转移
D. 腺行转移
E. 淋巴转移

正确答案：A。直接蔓延

解析：本题考查宫颈癌。直接蔓延（A对）：最常见。肿瘤可向宫旁组织局部浸润，并向邻近组织器官扩散。如外生型常向阴道壁蔓延，宫颈管内的病灶可向上累及宫体。癌灶向两侧蔓延至主韧带、阴道旁组织，甚至延伸到骨盆壁。晚期癌灶可向前侵及膀胱，向后侵入直肠。癌灶压迫或侵及输尿管时可引起输尿管阻塞，肾盂积水。